医学科研的动机是
A. 尊重事实，坚持真理
B. 立足于科学依据，敢于持怀疑态度
C. 对医学科学事业忠诚，有献身精神
D. 推进医学科学的发展，促进人类健康
E. 信息共享，促进医学科学的进步

正确答案：D。推进医学科学的发展，促进人类健康

解析：医学科研的动机应是为了推进医学科学的发展，使其更好地维护和促进人类的健康。掌握“医学科研伦理的含义和要求”知识点。